升浮性所示的作用是
A. 利水渗湿
B. 收敛固涩
C. 重镇安神
D. 止咳平喘
E. 祛风散寒

正确答案：E。祛风散寒

解析：本题考查的是升降浮沉的所示效用。升浮性所示的作用是祛风散寒（E对）。升和浮、沉和降，都是相对的。升是上升，降是下降，浮表示发散向外，沉表示收敛固藏和泻利等。一般说，升浮类药能上行向外，分别具有升阳发表、祛风散寒、涌吐、开窍等作用；沉降类药能下行向内，分别具有泻下、清热、利水渗湿（A错）、重镇安神（C错）、潜阳息风、消积导滞、降逆止呕、收敛固涩（B错）、止咳平喘（D错）等作用。